《中国药典》2015年版（一部）规定，细辛的药用部位为
A. 全草
B. 根
C. 根茎
D. 根及根茎
E. 地上部分

正确答案：D。根及根茎

解析：本题考查的是细辛的来源。《中国药典》2015年版（一部）规定，细辛的药用部位为根和根茎（D对）。细辛：【来源】为马兜铃科植物北细辛、汉城细辛或华细辛的干燥根和根茎。前两种习称“辽细辛”。全草（A错）类中药：指药用部位为草本植物新鲜或干燥的全体或地上部分（E错）的中药。根类（B错）中药：是指药用部位为根或以根为主，带有部分根茎或地上茎残基的药材。根茎类（C错）中药：系指入药部位是根茎或带有少量根部或肉质鳞叶的地下茎类药材及饮片。